与红细胞膜张力相等的溶液是
A. 等渗溶液
B. 等张溶液
C. 低渗溶液
D. 高渗溶液
E. 胶体溶液

正确答案：B。等张溶液